下列再植牙成功的判断标准，除外的是
A. 疼痛消失，无感染
B. X线片示牙根无异常透射影
C. 牙龈附着正常
D. 行使功能达7年以上
E. 牙齿无松动

正确答案：D。行使功能达7年以上

解析：再植牙成功的判断标准，一般认为是：疼痛消失，无感染，不松动，牙功能正常，牙龈附着正常。X线片示牙根无异常透射影。行使功能达5年以上，即为成功。掌握“牙槽外科”知识点。